肌纤维止于咬肌粗隆的骨骼肌是
A. 鼻肌
B. 胸锁乳突肌
C. 咬肌
D. 颞肌
E. 无

正确答案：C。咬肌

解析：鼻肌（A错）的肌纤维分布于鼻孔周围；胸锁乳突肌（B错）的肌纤维止于颞骨乳突；咬肌（C对）的肌纤维止于下颌骨咬肌粗隆；颞肌（D错）的肌纤维止于下颌骨冠突。